高钾血症的心电图特点是
A. QRS波宽，P-R间期延长，T波高尖
B. QRS波宽，P-R间期缩短，T波正常
C. QRS波变窄，P-R间期正常，T波高尖
D. QRS波变窄，P-R间期缩短，T波低平
E. QRS波正常，P-R间期延长，T波低平

正确答案：A。QRS波宽，P-R间期延长，T波高尖

解析：高钾血症的心电图特点是：QRS波宽（CDE错），P-R间期延长（B错），T波高尖（A对）。